不参与构成肛直肠环
A. 肛门外括约肌皮下部
B. 肛门外括约肌浅部
C. 肛门内括约肌
D. 肛提肌
E. 肠壁纵行肌

正确答案：A。肛门外括约肌皮下部

解析：肛直肠环由肛门外括约肌浅部(B对)和深部、肛门内括约肌(C对)、肛提肌(D对)和直肠壁下部纵行肌(E对)构成，肛门外括约肌皮下部不参与构成肛直肠环(A错，为本题正确答案)。